患者，女，29岁，已婚。妊娠2个月，因饮食不慎始觉脘腹胀痛，恶心呕吐，泄泻，舌淡红，苔白腻，脉滑。治疗应首选
A. 苍术
B. 厚朴
C. 枳实
D. 砂仁
E. 木香

正确答案：D。砂仁

解析：患者出现了湿浊中阻所致的脘腹胀痛，恶心呕吐，泄泻；舌苔白腻，脉滑也是一派湿象，同时患者为妊娠期女性，因此应选用化湿开胃，温脾止泻，理气安胎的砂仁（D对）。苍术（A错）的功效是燥湿健脾，祛风散寒，明目。厚朴（B错）的功效是燥湿消痰，下气除满。枳实（C错）的功效是破气消积，化痰除痞。木香（E错）的功效是行气止痛，健脾消食。